六淫邪气中，最易伤肺的是
A. 风
B. 寒
C. 暑
D. 燥
E. 火

正确答案：D。燥

解析：风为百病之长，凡寒、湿、燥、热等病邪可依附风侵犯人体，风邪为病，常伤及人体的阳位，如头面部、阳经和肌表（A错）。寒邪致病有外寒与内寒之分，最易损伤人体阳气，如寒邪直中脾胃等（B错）。暑邪致病有明显的季节性，暑为火热之气所化，可扰动心神，侵及心。暑多挟湿邪侵犯人体，易耗气伤津，侵及肺脾等脏（C错）。肺为娇脏，喜润而恶燥，且肺主气司呼吸，与大气相通，又外合皮毛，开窍于鼻，故燥邪伤人，从口鼻而入最易损伤肺之气津，导致肺失宣降（D对）。火邪致病易扰心神，出现心烦失眠甚至狂躁不安或神昏的症状，易生风动血，引起肝风内动的病证（E错）。